有关婚育指导中不宜结婚的疾病的说法错误的是
A. 双方患有精神分裂症
B. 双方患有性病
C. 一方患有严重遗传性疾病
D. 一方患有遗传性智力低下
E. 双方为五代以内旁系血亲关系

正确答案：E。双方为五代以内旁系血亲关系

解析：本题考查婚育指导的相关内容。五代旁系血亲可以结婚（E错，为本题正确答案），三代以内的旁系血亲禁止结婚。有关婚育指导中不宜结婚的疾病有：双方患有精神分裂症（A对）、双方患有性病（B对）、一方患有严重遗传性疾病（C对）、一方患有遗传性智力低下（D对）等。